不完全抗原（半抗原）
A. 是蛋白质大分子
B. 有免疫原性
C. 有免疫反应性
D. 与抗原决定簇无关
E. 与载体的含义相似

正确答案：C。有免疫反应性

解析：抗原一般具有两个重要特性，一是免疫原性，二是免疫反应性（抗原性）。同时具有免疫原性和免疫反应性的物质完全抗原，只具有免疫反应性（C对B错）的小分子物质（A错）称为不完全抗原又称半抗原。载体（E错）是指能传递能量或运载其他物质的物体。抗原决定簇是决定抗原特异性的特殊化学基团，半抗原的抗原特异性也是由抗原决定簇所决定的（D错）。